工人王某，是东北某地炼铁厂炉前工，上班时定期开炉观察冶炼状态并采集分析，工龄25年，一年来感到视物模糊，逐渐加重，前来就医。该工人常年接触的主要职业性有害因素是
A. 高温
B. 紫外线
C. 红外线
D. 可见光
E. 高毒气体

正确答案：C。红外线